恒牙萌出机制中有一种被称为“被动萌出”，此种萌出是以下哪种结构与釉质表面分离所致
A. 口腔黏膜上皮
B. Serre上皮剩余
C. 缩余釉上皮
D. 结合上皮
E. 马拉瑟上皮剩余

正确答案：C。缩余釉上皮

解析：牙冠萌出到口腔，一方面是牙本身（牙合）向运动的结果，即主动萌出；另一方面是由于缩余釉上皮与釉质表面分离，临床牙冠暴露，牙龈向根方移动来完成的，即为被动萌出。掌握“牙胚的发生及分化”知识点。